以下属于牙髓电活力测验禁忌症的是
A. 甲状腺机能亢进症
B. 冠心病
C. 高血压
D. 装心脏起搏器者
E. 癫痫病

正确答案：D。装心脏起搏器者

解析：本题考查牙髓电活力测验法的禁忌证。牙髓电活力测验是通过牙髓电活力测验仪来检测牙髓神经成分对电刺激的反应，主要用于判断牙髓“生”或“死”的状态。牙髓活力测验仪可干扰心脏起搏器的工作，该项测验禁用于心脏安装有起搏器的患者（D对）。甲状腺机能亢进症（A错）、冠心病（B错）、高血压（C错）、癫痫病（E错）患者可以在其病情稳定时进行牙髓电活力测验，且这些疾病对牙髓活力测验结果的影响小。